克罗恩病的典型X线征象是
A. 充盈缺损
B. 鹅卵石征
C. 杯口征
D. 铅管征
E. 鸟嘴征

正确答案：B。鹅卵石征

解析：克罗恩病时，其X线钡剂造影可见肠黏膜皱襞粗乱、纵行性溃疡或裂沟、鹅卵石征（B对）、假息肉、多发性狭窄或肠壁僵硬、瘘管形成等征象。充盈缺损（A错）多见于占位性病变，如良恶性肿瘤等。杯口征（C错）是肠套叠典型X线表现。铅管征（D错）主要见于溃疡性结肠炎。鸟嘴征（E错）是乙状结肠扭转的典型X线表现。